有关病证的虚实变化，以下哪项叙述是正确的
A. 病证的虚实变化主要取决于正邪双方力量的盛衰
B. 病证的虚实变化主要取决于气血是否旺盛
C. 病证的虚实变化主要取决于邪气亢盛与否
D. 病证的虚实变化主要取决于正气旺盛与否
E. 病证的虚实变化主要取决于脏腑功能盛衰

正确答案：A。病证的虚实变化主要取决于正邪双方力量的盛衰

解析：虚实转变取决于邪正盛衰（A对）。在疾病发展过程中，邪正双方的对比经常发生着变化，当邪正双方力量的消长变化达到主要与次要矛盾方面互易其位的程度时，则疾病的虚实性质亦会发生转变，呈现由实转虚或由虚致实的变化（BCDE错）。